弥漫性硬化性肾小球肾炎的肾脏表现为
A. 大红肾
B. 颗粒性固缩肾
C. 大白肾
D. 蚤咬肾
E. 瘢痕性固缩肾

正确答案：B。颗粒性固缩肾

解析：弥漫性硬化性肾小球肾炎即慢性肾小球肾炎，是不同类型肾小球肾炎发展的终末阶段。肉眼观，双肾体积缩小，表面呈弥漫性细颗粒状，称为继发性颗粒性固缩肾（B对）。大红肾（A错）、蚤咬肾（D错）是急性弥漫性肾小球肾炎（P266）的肾脏表现。大白肾（P269）（C错）是膜性肾小球病（P269）的肾脏表现。瘢痕性固缩肾（E错）即动脉粥样硬化性（AS）固缩肾（P137），是动脉粥样硬化症累及肾脏时的表现。